下列哪种情况下乳牙早失可不用间隙保持器
A. 继承恒牙先天缺失，结合牙列情况决定关闭间隙
B. X线片示继承恒牙胚上面覆盖的牙槽骨较厚
C. 如第一恒磨牙尚未萌出，而第一乳磨牙丧失
D. 如第一恒磨牙已萌出，而第一乳磨牙被拔除
E. 乳尖牙早失

正确答案：A。继承恒牙先天缺失，结合牙列情况决定关闭间隙

解析：本题考查乳牙间隙保持的适应证。恒牙胚先天缺失，应与正畸、修复医师会诊，决定治疗方案，若结合牙列情况决定关闭间隙（A对），则可不用间隙保持器。若X线片示继承恒牙胚上面覆盖的牙槽骨较厚（B错），则恒牙胚近期不会萌出，需使用间隙保持器保持间隙。如第一恒磨牙尚未萌出，而第一乳磨牙丧失（C错），为防止第一恒磨牙萌出时的近中倾斜移动力施加于第二乳磨牙，使第一前磨牙所需的间隙缩窄，需使用间隙保持器。如第一恒磨牙已萌出，而第一乳磨牙被拔除（D错），仍需使用间隙保持器，防止第二乳磨牙向前倾斜。乳尖牙早失（E错），间隙极易变小，致使恒尖牙异位萌出，故需使用间隙保持器保持间隙。